关于病死率的描述不正确的是
A. 用于说明疾病的危害程度
B. 医护水平的提高可以降低病死率
C. 不可以直接比较不同医院的病死率
D. 患病率的降低可以降低病死率
E. 诊断水平提高可以降低病死率

正确答案：D。患病率的降低可以降低病死率

解析：本题考查病死率的相关内容。病死率表示一定时期内因某病死亡者占该病病人的比例，表示某病病人因该病死亡的危险性。病死率表示确诊疾病的死亡概率，它可反映疾病的严重程度（A对），也可反映医疗水平（B对）和诊断能力（E对）。用病死率作为评价不同医院的医疗水平时要注意医院间的可比性，不可以直接比较（C对）。一种疾病的病死率受疾病严重程度、诊断及治疗水平和病原体毒力的影响，患病率的降低不能降低病死率（D错，为本题正确答案）。